阴阳互根互用的内容包括
A. 阴阳的依存关系
B. 阴阳消长的基本形式
C. 阴阳的相对属性
D. 阴阳转化的内在依据
E. 事物发展变化的条件

正确答案：A、D、E。阴阳的依存关系；阴阳转化的内在依据；事物发展变化的条件

解析：本题考查的是阴阳的互根互用。阴阳互根互用的内容包括阴阳的依存关系（A对）、阴阳转化的内在依据（D对）与事物发展变化的条件（E对）。阴阳的相互关系：（一）阴阳的对立制约（C错）：阴阳对立，是指事物或现象中阴与阳两个方面，具有阴阳相反、相互制约的关系，又称“阴阳对待”。人体之所以能进行正常的生命活动，就是阴与阳相互制约，取得了相对的动态平衡，称之为“阴平阳秘”。（二）阴阳的互根互用：阴阳互根互用，是指事物或现象中相互对立的阴阳两个方面，具有相互依存、相互为用的关系，又称“阴阳互藏”。阴阳的互根互用，是阴阳转化的内在根据。由于阴和阳本来就是相互关联事物的对立双方，或本是一个事物内部的对立双方，因而阴和阳在一定的条件下，可以各自向着自已相反的方面转化。（三）阴阳的消长平衡（B错）：阴阳的消长平衡，是指在一定的限度内，阴或阳的运动变化出现减少或增加的量变形式。消，即减少、消耗；长，即增多、增加。阴阳的消长平衡以阴阳对立互根为基础，体现此消彼长、此长彼消、此消彼消、此长彼长四种基本形式。阴阳的消长平衡，符合事物运动规律，即运动是绝对的，静止是相对的；消长是绝对的，平衡是相对的。（四）阴阳的相互转化：阴阳转化，是指在一定的条件下，阴或阳可以各自向其相反方向转化的质变形式，即由阴转阳、由阳转阴。阴阳相互转化的条件，一般都表现在事物变化的“物极”阶段。如果说“阴阳消长”是一个量变过程的话，则阴阳转化便是在量变基础上的质变。阴阳对立双方之所以能够相互转化，是因为对立的双方已相互存在着向其对立面转化的因素，即存在着阴阳依存的关系，这就是事物转化的内在根据。